有机磷农药中毒的机制是
A. 抑制磷酸二酯酶
B. 抑制单胺氧化酶
C. 抑制胆碱酯酶
D. 抑制腺苷酸环化酶
E. 直接激动胆碱受体

正确答案：C。抑制胆碱酯酶